经济因素对健康的作用可以表述为
A. 经济发展只对健康起到正向的促进作用
B. 经济发展不是最关键的因素
C. 经济促进健康的改善和提高，健康的人群促进经济的稳定发展
D. 发达国家的人健康
E. 经济通过文化教育作用于健康

正确答案：C。经济促进健康的改善和提高，健康的人群促进经济的稳定发展